食品不得加入药物，但是下列哪一类除外
A. 符合食品卫生标准和卫生要求而加入的
B. 为防病等特殊需要加入的
C. 为具有特定保健功能而加入的
D. 利用新资源生产的食品新品种
E. 按照传统既是食品又是药品的作为原料、调料或者营养强化剂加入的

正确答案：E。按照传统既是食品又是药品的作为原料、调料或者营养强化剂加入的